正常老年人动脉血压的生理性变化特点是
A. 主要为收缩压升高
B. 收缩压与舒张压均升高
C. 主要为舒张压升高
D. 收缩压降低，舒张压升高
E. 收缩压升高，舒张压降低

正确答案：E。收缩压升高，舒张压降低

解析：主动脉和大动脉的弹性储器作用对减小动脉血压在心动周期中的波动幅度具有重要意义。心脏收缩射血时，主动脉和大动脉被扩张，可多容纳一部分血液，使得射血期动脉压不会升得过高。当进入舒张期后，扩张的主动脉和大动脉依其弹性回缩，推动射血期多容纳的那部分血液流入外周，这一方面可将心室的间断射血转变为动脉内持续流动的血液，另一方面又可维持舒张期血压，使之不会过度降低。老年人由于动脉管壁硬化，管壁弹性纤维减少而胶原纤维增多，导致血管可扩张性降低，大动脉的弹性储器作用减弱，对血压的缓冲作用减弱，造成收缩压升高，舒张压降低（E对），使脉压明显加大。